黄体酮
A. 与亚硝基铁氰化钠的反应
B. 与斐林试剂的反应
C. 与醋酸铅试液的反应
D. 与氨制硝酸银试液的反应
E. 与三氯化铁试液的反应

正确答案：A。与亚硝基铁氰化钠的反应

解析：本题考查黄体酮的鉴别。黄体酮与亚硝基铁氰化钠反应显蓝紫色（A对），此反应是黄体酮专属、灵敏的鉴别反应。